某地疾病预防控制中心报告，该地近年来乙型肝炎发病率持续下降，则该地可能采取的控制乙肝流行的重要措施是
A. 管好水源
B. 提高食品卫生监督和管理质量
C. 采取免疫预防为主的综合措施
D. 降低HDV感染率
E. 加强粪便无害化管理

正确答案：C。采取免疫预防为主的综合措施

解析：本题考查乙型肝炎的防制措施。我国乙肝防制采取免疫预防为主，防治兼顾的综合措施（C对ABDE错）。其中乙肝疫苗免疫接种是预防和控制HBV感染的最有效的措施。